下列能够抑制甲状腺激素释放的物质为
A. 碘剂
B. TSH
C. 丙硫氧嘧啶
D. 普萘洛尔
E. I131

正确答案：A。碘剂

解析：碘剂的作用在于抑制蛋白水解酶，减少甲状腺球蛋白的分解，从而抑制甲状腺素的释放，碘剂还能减少甲状腺的血流量，使腺体充血减少，因而缩小变硬（A对）。TSH（B错）是促甲状腺激素，会使甲状腺激素释放更多。丙硫氧嘧啶（C错）通过抑制甲状腺内过氧化物酶系统，阻止甲状腺内酪氨酸的碘化及碘化酪氨酸的缩合，从而抑制甲状腺激素的合成。普萘洛尔（D错）为非选择性β1与β2肾上腺素受体阻滞剂，使心率减慢，心肌收缩力减弱，心排血量减少，在甲状腺手术中使用主要是为了减轻甲亢所导致的心动过快以及心悸，震颤的症状。I131（E错）是I的放射性同位素。I是甲状腺合成甲状腺素的主要原料，口服碘I131后，可作为有功能甲状腺组织的显像剂。